某地发生一起急性中毒事件，257人出现恶心、呕吐、视物模糊，重者出现失明、呼吸困难、昏迷，12人死亡，经调查发现患者发病前均食用了散装白酒。引起这一事件的有毒成分可能为
A. 甲醛
B. 杂醇油
C. 甲醇
D. 铅
E. 氢氰酸

正确答案：C。甲醇